经批准具备一定条件的药品零售连锁企业可以经营的药品是
A. 麻醉药品
B. 第一类精神药品
C. 第二类精神药品
D. 放射性药品
E. 第一类疫苗

正确答案：C。第二类精神药品

解析：本题考查的是药品零售企业不得经营的药品种类。经批准具备一定条件的药品零售连锁企业可以经营的药品是第二类精神药品（C对）。药品零售企业不得经营的药品种类：药品零售企业不得经营的药品：麻醉药品、放射性药品、第一类精神药品、终止妊娠药品（包括含有“米非司酮”成分的所有药品制剂）、蛋白同化制剂、肽类激素（胰岛素除外）、药品类易制毒化学品、疫苗，以及我国法律法规规定的其他禁止零售的药品。药品零售企业也不得经营中药配方颗粒、医疗机构制剂。